根据《城镇职工基本医疗保险用药范围管理暂行办法》，由国家制定，各省、自治区、直辖市不可进行调整的药品目录是
A. 《国家非处方药目录》
B. 《基本医疗保险药品目录》中的“甲类目录”
C. 《基本医疗保险药品目录》中的“乙类目录”
D. 《城市社区农村基本用药目录》
E. 《国家基本药物目录》

正确答案：B、C。《基本医疗保险药品目录》中的“甲类目录”；《基本医疗保险药品目录》中的“乙类目录”

解析：本题考查的是医保药品目录制定与调整。根据《城镇职工基本医疗保险用药范围管理暂行办法》，由国家制定，各省、自治区、直辖市不可进行调整的药品目录是《基本医疗保险药品目录》中的“甲类目录”（B对）与“乙类目录”（C对）。医保药品目录制定与调整：国家医疗保障局负责制定医保药品目录准入谈判规则并组织实施。根据《2019年国家医保药品目录调整工作方案》，目录调整工作由国家医疗保障局牵头，会同工业和信息化部、财政部、人力资源社会保障部、国家卫生健康委、国家药品监督管理局、国家中医药管理局研究制定工作方案，研究确定目录调整的原则、程序，协调政策问题。目录调整分为准备、评审、发布常规准入目录、谈判、发布谈判准入目录5个阶段。根据《关于印发〈国家基本医疗保险、工伤保险和生育保险药品目录〉的通知》，各地不得自行制定目录或用变通的方法增加目录内药品，也不得自行调整目录内药品的限定支付范围。对于原省级药品目录内按规定调增的乙类药品，应在3年内逐步消化。消化过程中，各省应优先将纳入国家重点监控范围的药品调整出支付范围。对于经国家有关部门批准上市的民族药品，可由各省级医疗保障部门牵头，会同人力资源社会保障部门根据当地的基金负担能力及用药需求，经相应的专家评审程序纳入本省（区、市）基金支付范围。各省调整民族药品的情况应报国家医保局备案后向社会公开。医保药品目录中的中药饮片是从有国家标准的中药饮片中经专家评审产生的。对于其他有国家或地方标准的中药饮片，可由各省级医疗保障部门牵头，会同人力资源社会保障部门根据当地的基金负担能力及用药需求，经相应的专家评审程序纳入本省（区、市）基金支付范围，但不得增加目录中规定的不予支付的饮片。对于经省级药品监督管理部门批准的治疗性医院制剂，可由省级医疗保障部门牵头，会同人力资源社会保障部门根据当地的基金负担能力及用药需求，经相应的专家评审程序，制定纳入本省（区、市）基金支付范围的医院制剂目录，并按照有关规定限于特定医疗机构使用。